藻酸盐印模材料中藻酸钾的作用是
A. 增稠剂
B. 填料
C. 弹性基质
D. 稀释剂
E. 缓凝剂

正确答案：C。弹性基质

解析：本题考查藻酸盐印模材料的组成。藻酸盐印模材料中藻酸钾的作用是弹性基质（C对）。藻酸钾是藻酸盐的一种，另一种是藻酸钠，其溶于水后呈溶胶状态，成为弹性基质，与钙离子反应形成凝胶。增稠剂（A错）主要是硼砂，其作用是增加溶胶的稠度，提高材料韧性，调节材料流动性，且有一定加速凝固的作用。填料（B错）主要是惰性物质，滑石粉、硅藻土、碳酸钙等，能够充实材料体积，提高材料硬度和压缩强度。稀释剂（D错）是水，用来分散介质。缓凝剂（E错）主要是无水碳酸钠、磷酸三钠及草酸盐等，目的是为了延缓藻酸盐凝固的时间，使印模材料具有一定的工作时间。